不易透过血脑屏障，无明显中枢抑制作用的H₁受体阻断剂是
A. 异丙嗪
B. 苯海拉明
C. 氯苯那敏
D. 阿司咪唑
E. 山莨菪碱

正确答案：D。阿司咪唑

解析：异丙嗪（A错）、苯海拉明（B错）、氯苯那敏（C错）均为常用的第一代H₁受体阻断药，因对中枢作用强、受体特异性差，故引起明显的镇静和抗胆碱作用，表现出困倦、耐药、作用时间短、口、鼻、眼干等不良反应，临床主要用于皮肤黏膜过敏、晕动症等。阿司咪唑（D对）属于第二代H₁受体阻断剂，不易通过血脑屏障，故中枢作用较弱或无，具有长效、无嗜睡作用、对喷嚏、清涕和鼻痒效果好，对鼻塞效果差的特点，临床也主要用于皮肤黏膜过敏。山莨菪碱（E错）属于M胆碱受体阻断剂。